抑制胃壁细胞H₂受体的药物是
A. 碳酸氢钠
B. 西咪替丁
C. 奥美拉唑
D. 米索前列醇
E. 胃蛋白酶

正确答案：B。西咪替丁

解析：本题考查H₂受体阻断药。西咪替丁（B对）为第一代的H₂受体拮抗药。碳酸氢钠（A错）为抗酸药。奥美拉唑（C错）为质子泵抑制剂。米索前列醇（D错）为黏膜保护药。胃蛋白酶（E错）为助消化药。